某县医院妇产科医师欲开展结扎手术业务，按照规定参加了相关培训。培训结束后，有关单位负责对其进行了考核并颁发给相应的合格证书。该有关单位是指
A. 地方医师协会
B. 地方卫生行政部门
C. 卫生部
D. 地方医学会
E. 所在医疗保健机构

正确答案：B。地方卫生行政部门

解析：根据《母婴保健法》规定，结扎手术和终止妊娠手术人员的考核发证，由县级以上的地方卫生行政部门（B对）负责。遗传病诊断和产前诊断人员的考核发证，由省、自治区、直辖市卫生行政部门负责。婚前医学检查人员考核发证由设区的市级以上地方卫生行政部门负责。从事家庭接生的人员的考核发证，由县级卫生行政部门负责。